国务院办公厅转发的《关于城镇医药卫生体制改革的指导意见》规定，医疗机构药品集中招标采购必须坚持
A. 公平、公正竞争的原则
B. 公开、公平竞争的原则
C. 自愿、平等竞争的原则
D. 自愿、公开竞争的原则
E. 公正、合理竞争的原则

正确答案：B。公开、公平竞争的原则